不属于大气污染对健康直接危害的是
A. 慢性中毒
B. 变态反应
C. 急性中毒
D. 肺癌
E. 佝偻病

正确答案：E。佝偻病

解析：本题考查大气污染对健康的直接危害。大气污染对健康的直接危害有：慢性中毒（A对）、急性中毒（C对）、变态反应（B对）、肺癌（D对）等。佝偻病即维生素D缺乏性佝偻病，是由于婴幼儿、儿童、青少年体内维生素D不足，引起钙、磷代谢紊乱，产生的一种以骨骼病变为特征的全身、慢性、营养性疾病。佝偻病（E错，为本题正确答案）属于大气污染对健康的间接危害。